易发生骨折的面骨为
A. 颧骨
B. 颧弓
C. 上颌骨
D. 下颌骨
E. 腭骨

正确答案：D。下颌骨

解析：本题考查易发生骨折的面骨。下颌骨有些部位在结构和力学上属于薄弱区域，是颌面部骨折率最高的面骨（D对）。上颌骨包括腭骨（CE错）、颧骨（A错）、颧弓（B错）、鼻筛区诸骨和额骨的一部分，合称为面中部骨，约占颌面部骨折的40%以上。